固定义齿修复后瓷层破损的原因中可能性最小的是
A. 咬合早接触
B. 前牙舌侧预备1mm空间
C. 金属材料与瓷粉不匹配
D. 制作时金属基底表面污染
E. 固定桥基底桥架牙合面余0．5mm空间

正确答案：B。前牙舌侧预备1mm空间

解析：本题考查瓷崩裂的原因。固定桥修复时，前牙舌侧预备1mm空间（B错，为本题的正确答案），为瓷层提供了足够的空间，一般不会引起崩瓷，为固定义齿修复后瓷层破损的原因中可能性最小的。固定义齿修复后的牙冠存在咬合早接触（A对）时，应力集中，烤瓷冠或全瓷冠的瓷层易崩瓷。烤瓷冠的材料选择不妥时，金属材料与瓷粉膨胀系数不匹配（C对），制作完成的烤瓷冠可能存在微小的空隙，烤瓷冠易崩瓷。制作时金属基底表面污染（D对），使不透明瓷烧结不全，不能和金属基底形成良好的化学结合，易崩瓷。在不影响桥体强度的前提下，桥体支架应尽可能缩小，并留出瓷层足够而均匀的空间，至少为1～1.5mm，0.5mm（E对）的空间不足，易崩瓷。